感染的含义是
A. 病原体侵入人体的过程
B. 是病原体对人体的一种寄生过程
C. 病原体侵入人体的一种方式
D. 人对病原体缺乏抵抗力而发病
E. 病原体与人体相互作用的过程

正确答案：E。病原体与人体相互作用的过程

解析：感染是指病原体和人体之间相互作用的过程。掌握“传染病总论”知识点。